水银血压计的示值允许误差为
A. ±2.25mmHg
B. ±3.00mmHg
C. ±3.75mmHg
D. ±4.50mmHg
E. ±5.25mmHg

正确答案：C。±3.75mmHg